下列哪项不适用腭前神经阻滞麻醉
A. 上颌前磨牙拔除术腭侧麻醉
B. 上颌磨牙拔除术腭侧麻醉
C. 腭隆凸切除术
D. 上颌磨牙拔除术颊侧麻醉
E. 硬腭部位手术

正确答案：D。上颌磨牙拔除术颊侧麻醉

解析：本法适用于上颌前磨牙、磨牙拔除术的腭侧麻醉，腭隆凸切除术及硬腭部位的某些手术等，可能同时需配合其他阻滞麻醉或者浸润麻醉。掌握“颌面部常用局麻法及牙拔除的麻醉选择”知识点。